16岁女孩，前牙牙列不齐、拥挤、前牙唇侧牙间乳头呈球状突起，质地松软光亮，有少量菌斑等。此患者最有可能的诊断是
A. 牙龈纤维瘤病
B. 妊娠期龈炎
C. 药物性牙龈增生
D. 青春期龈炎
E. 白血病

正确答案：D。青春期龈炎

解析：本题考查青春期龈炎。青春期龈炎菌斑是主要病因，由于乳恒牙交替、牙齿排列不齐、口呼吸及戴矫治器造成牙齿不易清洁（D对）。牙龈纤维瘤病龈缘、龈乳头和附着龈广泛增生，甚至达到膜龈联合，增生的牙龈颜色正常，组织坚韧，表面光滑，点彩明显，不易出血（A错）。妊娠期龈炎为妊娠期间龈缘、龈乳头显著的炎性肿胀、肥大，呈鲜红色或暗红色，松软光亮，易出血，也可表位瘤样肥大（B错）。药物增生性牙龈炎可表线为龈乳头呈球状、结节状，色呈淡粉红色，质地坚韧。略有弹性，有服药史（C错）。白血病的牙龈病损可表现为牙龈乳头、龈缘和附着龈肿大，颜色暗红发绀或苍白，极易出血且止不住（E错）。